最易发生腺源性感染的间隙为
A. 眶下间隙
B. 翼下颌间隙
C. 咬肌间隙
D. 下颌下间隙
E. 颞间隙感染

正确答案：D。下颌下间隙

解析：本题考查下颌下间隙感染。下颌下间隙感染（D对）常来自下颌智牙冠周炎、下颌后牙根尖周炎、牙槽脓肿等牙源性感染，或下颌下淋巴结炎扩散，最易产生腺源性感染。眶下间隙感染（A错）多来自上颌尖牙，第一前磨牙和上颌切牙的根尖化脓性炎症和牙槽脓肿，以牙源性为主。翼下颌间隙感染（B错）常来自下颌智牙冠周炎及下颌磨牙根尖周炎症扩散、下牙槽神经阻滞麻醉时消毒不严或拔下颌智齿时创伤过大、相邻间隙炎症等，以牙源性为主。咬肌间隙感染（C错）常来自下颌智牙冠周炎，下颌磨牙的根尖周炎、牙槽脓肿，相邻间隙如颞下间隙感染的扩散，化脓性腮腺炎波及，以牙源性为主。颞间隙感染（E错）常来自咬肌间隙、翼下颌间隙、颞下间隙、颊间隙感染的扩散或耳源性感染、颞部疖痈、颞部损伤继发感染。